风湿马钱片具有祛风除湿、活血祛瘀、通络止痛的作用，用于风湿闭阻、瘀血阻络所致的痹病。处方组成：马钱子粉125g、炒僵蚕19g、乳香（炒）19g、没药（炒）19g、全蝎19g、牛膝19g、苍术19g、麻黄19g、甘草19g。制法：以上九味全蝎、乳香、没药和炒僵蚕粉碎成细粉；麻黄、苍术分别用70%乙醇作溶剂进行渗漉，收集漉液约180ml，回收乙醇浓缩成稠膏；甘草和牛膝加水煎煮三次煎液滤过滤液合并浓缩成稠膏，与上述稠膏合并，加入马钱子粉及全蝎等四味药的细粉，混匀制成颗粒，干燥压制成1000片包糖衣即得。处方中略呈圆柱形，表面黄棕色或黄白色，偶有焦黄斑，气微的饮片是
A. 炒僵蚕
B. 全蝎
C. 乳香（炒）
D. 没药（炒）
E. 牛膝

正确答案：A。炒僵蚕

解析：本题考查的是僵蚕饮片的性状鉴别。处方中略呈圆柱形表面黄棕色或黄白色偶有焦黄斑气微的饮片是炒僵蚕（A对）。僵蚕：【性状鉴别】饮片炒僵蚕略呈圆柱形，多弯曲皱缩。表面黄棕色或黄白色，偶有焦黄斑。气微腥，有焦麸气，味微咸。全蝎（B错）：【性状鉴别】饮片头胸部与前腹部呈扁平长椭圆形，后腹部呈尾状，皱缩弯曲。头胸部呈绿褐色，前面有1对短小的螯肢及1对较长大的钳状脚须，形似蟹螯，背面覆有梯形背甲，腹面有足4对；前腹部由7节组成。背面绿褐色，后腹部棕黄色，6节，节上均有纵沟，末节有锐钩状毒刺，毒刺下方无距。气微腥，味咸。乳香（炒）（C错）为乳香的饮片。乳香：【性状鉴别】饮片醋乳香呈长卵形滴乳状、类圆形颗粒或黏合成大小不等的不规则块状物。表面深黄色，显油亮。略有醋香气。没药（炒）（D错）为没药的饮片。没药：【性状鉴别】饮片醋没药为不规则小块状或类圆形颗粒状，表面棕褐色或黑褐色，有光泽。具特异香气，略有醋香气，味苦而微辛。牛膝（E错）：【性状鉴别】饮片呈圆柱形的段。外表皮灰黄色或淡棕色，有微细的纵皱纹及横长皮孔。质硬脆，易折断，受潮变软。切面平坦，淡棕色或棕色，略呈角质样而油润，中心维管束木质部较大，黄白色，其外围散有多数黄白色点状异型维管束，习称“筋脉点”，断续排列成2～4轮。气微，味微甜而稍苦涩。